男，15岁。2天前被社会青年欺负以后，感紧张、恐惧，不敢上学，晚上常梦见类似情境，要求家人陪伴，稍有响动就感紧张。最可能的诊断是
A. 人格解体障碍
B. 惊恐障碍
C. 适应障碍
D. 急性应激障碍
E. 创伤后应激障碍

正确答案：E。创伤后应激障碍

解析：患者青少年男性，2天前被社会青年欺负后（遭受异乎寻常的威胁性心理创伤），感紧张、恐惧，不敢上学，晚上常梦见类似情景（反复出现有创伤性内容的噩梦），要求家人陪伴，稍有响动就感紧张（持续的警觉性增高），综合患者病史和症状，考虑诊断为创伤性应激障碍（E对）。人格解体障碍（A错）又称人格解体-现实解体综合征，是以持续或反复出现对自身或环境感到疏远或陌生的不愉快体验为特征的神经症性障碍。常出现于正常人疲乏时，吸毒和酗酒者，但历时短暂。惊恐障碍（B错）又称急性焦虑障碍。其主要特点是突然发作的、不可预测的、反复出现的、强烈的惊恐体验，一般历时5~20分钟，伴濒死感或失控感，患者常体验到濒临灾难性结局的害怕和恐惧，并伴有自主神经功能失调的症状。适应障碍（C错）的患者具有明显的生活或环境改变（如失业、迁居），产生短期的和轻度的烦恼状态和情绪失调，常有一定程度的行为变化等，但并不出现精神病性症状。急性应激障碍（D错）患者常在急剧、严重的精神刺激下，立即表现有强烈恐惧体验的精神运动性兴奋（激越，喊叫，行为过多），行为具有一定的盲目性，或者为精神运动性抑制，甚至木僵。